口服奥司他韦（达菲）治疗流感宜及早用药，较为有效的用药时间是症状出现的
A. 48h内
B. 72h内
C. 96h内
D. 108h内
E. 120h内

正确答案：A。48h内

解析：本题考查奥司他韦。口服奥司他韦（达菲）治疗流感宜及早用药，较为有效的用药时间是症状出现的48h内（A对）。奥司他韦用于与流感接触患者密切接触后的流感预防时的推荐剂量为一次75mg，一日1次，至少7日，应在密切接触后2日内开始用药。